维生素A缺法时引起
A. 癞皮病
B. 脚气病
C. 夜盲症
D. 坏血病
E. 佝偻病

正确答案：C。夜盲症

解析：本题考查维生素A缺乏症。维生素A缺法时引起夜盲症（C对）。癞皮病（A错）可见于维生素PP缺乏。脚气病（B错）可见于维生素B₁缺乏。坏血病（D错）可见于维生素C严重缺乏。佝偻病（E错）可见于维生素D缺乏可引起的钙吸收障碍。